诊断阻塞性肺气肿，最有价值的是
A. PO₂低于正常
B. 残气量/肺总量＞40%
C. 第一秒用力呼气量/用力肺活量＜60%
D. 最大通气量低于预计值的80%
E. 潮气量低于预计值的80%

正确答案：B。残气量/肺总量＞40%

解析：阻塞性肺气肿的特征性病理生理变化是持续气流受限致肺通气功能障碍。由于支气管和小气道的慢性炎症，导致肺组织弹性减低，肺泡腔持续增大，造成残气量和残气量占肺总量的百分比增加（B对），对阻塞性肺气肿的诊断有重要意义，残气量／肺总量＞40%为旧版教材说法。PO₂（动脉血氧分压）（A错）是指血液中物理溶解氧分子所产生的压力，用于判断有无缺氧和缺氧程度，判断有无呼吸衰竭，对阻塞性肺气肿诊断价值不大。最大通气量（D错）取决于三个因素：胸部的完整结构和呼吸肌的力量、呼吸道的通畅程度、肺组织弹性，阻塞性肺气肿时，会出现最大通气量低于预计值的80％，但是特异性低。潮气量（E错）是指在静息状态下每次吸入或呼出的气量，它与年龄、性别、体积表面、呼吸习惯、肌体新陈代谢有关。阻塞性肺气肿时，会出现潮气量低于预计值的80％但是跟B相比特异性低。注：九版内科学教材（P23）认为肺功能检查见持续气流受限是慢阻肺诊断的必备条件，吸入支气管扩张剂后FEV₁/FVC＜0.70为确定存在持续气流受限的界限，因此对于慢阻肺诊断最有价值的是在吸入支气管舒张剂后FEV₁/FVC＜0.70。